我国规定管理的急性传染病分为甲、乙、丙三类。其中属甲类的有
A. 肝炎
B. 流脑
C. 菌痢
D. 流感
E. 以上都不是

正确答案：E。以上都不是

解析：本题考查法定甲类传染病。我国规定的法定甲类传染病为鼠疫和霍乱（E对）。病毒性肝炎（A错）、流行性乙型脑炎（B错）、细菌性痢疾（C错）都属于乙类传染病。流行性感冒（D错）属于丙类传染病。